与根分叉病变有关的发病因素包括
A. 菌斑和牙石
B. 牙合创伤
C. 牙根的解剖形态
D. 牙髓感染的扩散
E. 以上都是

正确答案：E。以上都是

解析：本题考查根分叉病变的发病因素。根分叉病变是指牙周炎的病变和破坏波及了多根牙的根分叉区，在该处出现牙周袋、附着丧失和牙槽骨吸收。和根分叉病变有关的发病因素有：菌斑微生物是牙周病的始动因子，主要病因是菌斑和牙石（A对）；（牙合）创伤（B对）是根分叉病变的一个促进因素，会加重伴有根分叉病变患牙的根分叉处病变。根分叉病变与牙根的解剖形态（C对）有关：（1）根柱的长度：根柱越短越不易发生根分叉病变。（2）根分叉开口处的宽度及分叉角度：根分叉处宽度越小及分叉角度越小器械越不易进入，越不易清洁。（3）根面的外形：根面凹陷处的菌斑不易清洁，易引起根分叉病变。磨牙牙髓的感染和炎症可通过髓室底的副根管扩散（D对）蔓延至根分叉区，造成该处的骨吸收和牙周袋。（ABCD均对，故E为本题的正确答案）。